根尖部牙槽骨骨髓腔中纤维组织增生，散在慢性炎症细胞浸润，根尖部牙骨质过度沉积的现象，称为
A. 慢性根尖周肉芽肿
B. 急性浆液性根尖周炎
C. 慢性根尖周脓肿
D. 致密性骨炎
E. 急性牙槽脓肿

正确答案：D。致密性骨炎

解析：本题考查急慢性根尖周炎。致密性骨炎（D对）可以呈现出修复的迹象。吸收的牙槽骨重新沉积，骨小梁增粗，髓腔缩小，密度增大，髓腔中纤维组织增生，散在慢性炎症细胞浸润。同时吸收的牙骨质也出现修复，甚至过度沉积，出现牙骨质过度增厚。